当样本含量n足够大、样本率p和1-p均不接近于零的前提下，样本率的分布近似于
A. 偏态分布
B. 正态分布
C. 不规则分布
D. 一侧分布
E. 线性分布

正确答案：B。正态分布

解析：当样本含量n足够大、样本率p和1-p均不接近于零的前提下，样本率的分布近似于正态分布。掌握“分类资料的统计描述与推断”知识点。